决定对重度子痫前期患者实施扩容治疗前，下列何种检查最关键
A. 眼底检查
B. 24小时尿蛋白定量
C. 血浆总蛋白测定
D. 血细胞比容（红细胞压积）
E. 心电图检查

正确答案：D。血细胞比容（红细胞压积）

解析：妊高症扩容治疗：扩容治疗的指征是血液浓缩（血细胞比容≥0.35，全血粘度比重≥3.6，血浆粘度比重≥1.6及尿比重＞1.020）。常用扩容剂有血清蛋白、血浆、全血、右旋糖酐及平衡液等。应在解痉基础上扩容，扩容治疗时严密观察脉搏、呼吸、血压及尿量，防止肺水肿和心衰发生。掌握“娠期高血压疾病”知识点。